关于根管预备操作哪项是错误的
A. 使用扩孔锉和扩孔钻，由细到粗，依序号进行
B. 根管口可用球钻、大号扩孔钻或裂钻扩大
C. 对于根管狭窄、钙化或根管内异物可用螯合剂乙二胺四乙酸来处理
D. 凡旋转使用的器械，一般旋转时不要超过半圈
E. A+C+D

正确答案：B。根管口可用球钻、大号扩孔钻或裂钻扩大

解析：本题考查根管预备操作。根管口应用G钻，长颈球钻用于寻找变异和重度钙化的根管口，裂钻是制备洞形，不能扩大根管口（B错，为本题的正确答案）。根管预备的原则，根管锉不能跳号，即为由细到粗，依号进行（A对）。EDTA即乙二胺四乙酸是一种强螯合剂，可润滑根管壁去除玷污层（C对）。凡旋转使用的器械，一般旋转时不要超过半圈，防止发生器械分离（D对）。